有关高分子溶液剂的表述，正确的有
A. 高分子溶液剂系指高分子药物溶解于溶剂中制成的均匀分散的液体制剂
B. 亲水性高分子溶液与溶胶不同，有较高的渗透压
C. 制备高分子溶液剂要经过有限溶胀和无限溶胀过程
D. 无限溶胀过程，常需加以搅拌或加热等步骤才能完成
E. 形成高分子溶液过程称为胶溶

正确答案：A、B、C、D、E。高分子溶液剂系指高分子药物溶解于溶剂中制成的均匀分散的液体制剂；亲水性高分子溶液与溶胶不同，有较高的渗透压；制备高分子溶液剂要经过有限溶胀和无限溶胀过程；无限溶胀过程，常需加以搅拌或加热等步骤才能完成；形成高分子溶液过程称为胶溶

解析：本题考查高分子溶剂。高分子溶液剂系指高分子药物溶解于溶剂中制成的均匀分散的制剂（A对）。根据溶剂的不同可分为亲水性和非水性高分子溶液剂，其中亲水性高分子溶液与溶胶不同，有较高的渗透压（B对）；制备高分子溶液剂要经过有限溶胀和无限溶胀过程（C对），其中无限溶胀过程，常需加以搅拌或加热等步骤才能完成（D对）；形成高分子溶液过程称为胶溶（E对）。